患者心悸怔忡，神识朦胧，困倦易睡，畏寒肢冷，肢面浮肿，下肢为甚，舌淡暗苔白滑，其临床意义是
A. 痰湿困脾
B. 脾气虚弱
C. 心肾阳衰
D. 脾肾阳虚
E. 心肾不交

正确答案：C。心肾阳衰

解析：患者心肾阳虚，鼓动无力，故心悸怔忡；阳虚则寒，形体失于温养，脏腑功能衰退，畏寒肢冷；肾阳亏虚，蒸腾气化失司，三焦决渎不利，水湿内停，外溢肌肤，故肢面浮肿；阳气不振，推动无力，机能衰退，则神识朦胧，困倦易睡；舌淡暗苔白滑，为心肾阳虚，水湿内停之象；故辨证为心肾阳虚证（C对）。痰湿困脾是以气短，神疲，痰多而黏稠，胸脘痞闷，纳呆，倦怠乏力，身重嗜睡为主要表现的证（A错）。脾气虚弱是以纳少、腹胀、便溏及气虚症状为主要表现的证（B错）。脾肾阳虚证是以久泄久痢、浮肿、腰腹冷痛及阳虚症状为主要表现的证（D错）。心肾不交证是以心烦、失眠、梦遗、耳鸣、腰膝酸软等为主要表现的证（E错）。